关于氢氯噻嗪的不良反应，错误的是
A. 低血镁症
B. 高尿酸血症
C. 高血糖症
D. 高脂血症
E. 高血钾症

正确答案：E。高血钾症

解析：氢氯噻嗪的不良反应：①电解质紊乱：期用药可引起低血钾（E错，为本题正确答案）、低血钠、低血镁（A对）、低氯血症、代谢性碱血症②代谢异常：血糖升高（C对）、高血脂症（D对）③高尿酸血症（B对）④加重肾功能不良⑤过敏。